我国非处方药的遴选原则是
A. 应用广泛、无不良反应、质量可控、使用方便
B. 应用安全、疗效可靠、质量稳定、中西药结合
C. 应用广泛、疗效确切、结合国情、使用方便
D. 应用安全、疗效确切、质量稳定、使用方便
E. 应用广泛、疗效可靠、质量可控、中西药结合

正确答案：C。应用广泛、疗效确切、结合国情、使用方便